系统性红斑狼疮所产生的胸腔积液为
A. 漏出液
B. 渗出液
C. 脓性胸液
D. 血性胸液
E. 乳糜性胸液

正确答案：B。渗出液

解析：渗出液为炎性积液，形成的主要原因有感染、外伤、化学刺激、肿瘤、风湿性疾病等。系统性红斑狼疮属于风湿性疾病，其产生的胸腔积液为渗出液（B对）。漏出液（A错）是非炎性积液，主要形成原因是血浆胶渗压降低、毛细血管流体静压升高、淋巴管阻塞等。脓性胸液（C错）见于胸膜腔化脓性炎症。血性胸液（D错）见于创伤、外科手术、肿瘤、结核感染等。乳糜性胸液（E错）常是由于胸导管破坏、受压或浸润造成的，见于肿瘤、结核和外伤等疾病。